慢性增生性牙髓炎常见于
A. 青少年
B. 中年人
C. 老年人
D. 中年男性
E. 中年女性

正确答案：A。青少年

解析：慢性增生性牙髓炎：多发生于青少年的乳、恒磨牙，无自发性痛；大而深的龋洞中有红色的肉芽组织（牙髓息肉）充满龋洞；探诊不痛但易出血。掌握“可复性、急慢性牙髓炎”知识点。